男，45岁。发热3天，少尿1天，于12月15日入院。查体：BP60/30mmHg，神志清，球结膜充血、水肿，双腋下有出血点，实验室检查：WBC25×10⁹/L，plt50×10⁹/L，尿蛋白（+++）。为明确诊断应进行的检查示
A. 肥达-外斐试验
B. 尿培养
C. 血清汉坦病毒特异性抗体检测
D. 咽拭子培养
E. 钩端螺旋体显微凝集试验

正确答案：C。血清汉坦病毒特异性抗体检测

解析：45岁男性，发热3天（肾综合征出血热发热期全身中毒症状），少尿1天（肾综合征出血热少尿期），于12月15日入院（肾综合征出血热高发季节）；查体：BP60/30mmHg（血压低），神志清，球结膜充血、水肿，双腋下有出血点（毛细血管损害征），实验室检查：WBC25×10⁹/L（成人正常参考值4～10×10⁹/L），plt50×10⁹/L（100～300×10⁹/L），尿蛋白（+++）（肾损害），根据患者的临床表现和实验室结果，最可能的诊断是肾综合征出血热，为明确诊断应进行的检查是血清汉坦病毒特异性抗体检测（C对），在第2病日即能检出特异性IgM抗体，1：20为阳性。IgG抗体1：40为阳性，1周后滴度上升4倍或以上有诊断价值肥达-外斐试验（A错）常用于对伤寒辅助检查。流行性出血热为病毒感染，尿培养（B错）、咽拭子培养（D错）都不适用于本病诊断。钩端螺旋体显微凝集试验（E错）适用于钩端螺旋体诊断。